男，65岁，排尿延长、夜尿增多2年余，加重3月，排尿细碎、无力，盆腔B超：前列腺增大，突入膀胱。该病变的部位位于
A. 前列腺周围带
B. 前列腺移行区
C. 前列腺囊
D. 前列腺中央区
E. 纤维肌层

正确答案：B。前列腺移行区

解析：前列腺增生发生在移行区；前列腺癌发生在周围带（B对A错）。